可引起周围神经炎的药物是
A. 异烟肼
B. 对氨基水杨酸
C. 利福平
D. 乙胺丁醇
E. 环丙沙星

正确答案：A。异烟肼

解析：本题考查药物的不良反应。可引起周围神经炎的药物是异烟肼（A对）。异烟肼为维生素B₆的拮抗剂，可增加维生素B₆经肾排出量，易致周围神经炎的发生。同时服用维生素B₆者，需酌情增加用量。对氨基水杨酸（B错）常见不良反应常见胃肠道反应，也可引起皮疹、发热、关节痛、白细胞减少症和肝肾损害等。利福平（C错）不良反应常见消化道反应、肝毒性、类流感样综合征等。乙胺丁醇（D错）不良反应为球后视神经炎、胃肠道反应、过敏反应等。环丙沙星（E错）为喹诺酮类抗菌药，主要不良反应有肝毒性、心脏毒性、光毒性、易导致跟腱炎。